患者小便热涩疼痛，尿色深红，或夹有血块。应首先考虑的是
A. 热淋
B. 石淋
C. 气淋
D. 血淋
E. 劳淋

正确答案：D。血淋

解析：湿热下注膀胱，热盛伤络，迫血妄行，以致小便热涩疼痛，尿色深红；热邪煎熬阴血，形成瘀血，随尿而出，故或夹有血块；故诊断为血淋（D对）。热淋，其证候为小便频数短涩，灼热刺痛，溺色黄赤，少腹拘急胀痛，或有寒热，口苦，呕恶，或有腰痛拒按，或有大便秘结，苔黄腻，脉滑数（A错）。石淋，以小便排出砂石为主证，其证候为尿中央砂石，排尿涩痛，或排尿时突然中断，尿道窘迫疼痛，少腹拘急，往往突发，一侧腰腹绞痛难忍，甚则牵及外阴，尿中带血，舌红，苔薄黄，脉弦或带数(B错)。气淋，其证候为郁怒之后，小便涩滞，淋沥不宣，少腹胀满疼痛，苔薄白，脉弦（C错）。劳淋，其证候为小便不甚赤涩，溺痛不甚，但淋沥不已，时作时止，病程缠绵，遇劳即发，腰膝酸软，神疲乏力，舌质淡，脉细弱（E错）。